六合定中丸除和胃消食外，又能
A. 祛暑除湿
B. 补气生津
C. 健脾安神
D. 温中健脾
E. 清暑解毒

正确答案：A。祛暑除湿

解析：本题考查的是六合定中丸的功能。六合定中丸除和胃消食外，又能祛暑除湿（A对）。六合定中丸：【功能】祛暑除湿，和中消食。清暑益气丸：【功能】祛暑利湿，补气生津（B错）。附子理中丸：【功能】温中健脾（D错）。茯苓：【功效】利水渗湿，健脾，安神（C错）。功能为清暑解毒（E错）的中成药，2022年考试指南未明确说明。